执业医师处方权的取得方式是
A. 被医疗机构聘用后取得
B. 在注册的执业地点取得
C. 在上级医院进修后取得
D. 医师资格考试合格后取得
E. 参加卫生行政部门培训后取得

正确答案：B。在注册的执业地点取得

解析：经注册的执业医师在注册的执业地点取得（B对）相应的处方权。医师资格考试合格后取得的是执业医师资格（D错）。进修医师由接收进修的医疗机构对其胜任本专业工作的实际情况进行认定后授予相应的处方权（C错）。执业医师参加卫生行政部门培训考核合格后取得（E错）麻醉药品和第一类精神药品的处方权，药师经培训考核合格后可以去的麻醉药品和第一类精神药品调剂资格（P231）。